诊断小儿结核性脑膜炎的主要依据是
A. X线检查
B. 病史和临床表现
C. 结核菌素试验
D. 脑脊液常规检查
E. 脑CT扫描

正确答案：B。病史和临床表现